女性，21岁。3年来有发作性头痛，部位不定，每日1~2次，持续十几小时，伴恶心、呕吐、畏光，神经科体检未见明显异常。首先考虑的诊断是
A. 偏头痛
B. 丛集性头痛
C. 脑部占位性病变
D. 脑震荡后遗症
E. 头痛型癫痫

正确答案：A。偏头痛